国家基本药物制度对基本药物使用管理确定的原则是
A. 优先选择、合理使用
B. 强制采购、优先使用
C. 价格优先、质量合格
D. 以奖代补、全额报销

正确答案：A。优先选择、合理使用

解析：本题考查药材使用管理。国家基本药物制度对基本药物使用管理确定的原则是优先选择、合理使用。